在下列哪个部位可闻及支气管呼吸音属于病理性呼吸音
A. 喉部
B. 胸骨上窝
C. 背部第六七颈椎附近
D. 背部第一二胸椎附近
E. 右下肺

正确答案：E。右下肺

解析：正常人于喉部（A对），胸骨上窝（B对），背部第6、7颈椎（C对）及第1、2胸椎（D对）附近均可听到支气管呼吸音，且越靠近气管区，其音响越强，音调亦渐降低，在右下肺（E错，为本题正确答案）闻及支气管呼吸音属于病理性呼吸音。